新生儿缺氧缺血性脑病时发生惊厥，首选的药物是
A. 甘露醇
B. 地塞米松
C. 苯巴比妥钠
D. 苯妥英钠
E. 呋塞米

正确答案：C。苯巴比妥钠

解析：苯巴比妥钠是新生儿缺氧缺血性脑病时发生惊厥的首选药物的原因是：苯巴比妥钠有镇静止痉（C对）、降低脑代谢率的作用。苯妥英钠用于伴有肝功能不良的患儿（D错）。甘露醇（A错）、呋塞米（E错）不能控制惊厥，用于治疗脑水肿。地塞米松也不能控制惊厥（B错），在治疗脑水肿时也不主张使用糖皮质激素。